男孩，7岁，近期气短，乏力，查体：胸骨左缘第2肋间可闻及收缩期杂音，第二心音固定分裂，最可能诊断为
A. 肺动脉狭窄
B. 主动脉导管未闭
C. 室间隔缺损
D. 房间隔缺损
E. 法洛四联征

正确答案：D。房间隔缺损

解析：儿童，7岁，近期气短，乏力，查体：胸骨左缘第2肋间可闻及收缩期杂音（提示房间隔缺损），第二心音固定分裂，最可能诊断为房间隔缺损（D对），该病体格检查时可发现胸骨左缘第2-3肋间有收缩期杂音。肺动脉狭窄（A错）胸骨左缘第2、3 肋间可闻及IV/VI 级以上喷射性收缩期杂音，向左上胸、心前区、颈部、腋下及背面传导。动脉导管未闭（B错）胸骨左缘上方闻及连续性“机器”样杂音，占整个收缩期与舒张期，常伴有震颤，杂音向左锁骨下、颈部和背部传导。室间隔缺损（C错）在胸骨左缘第3、4肋间响亮的全收缩期杂音，常伴震颤。法洛四联征（E错）胸骨左缘第2-4肋间可闻及II -III级粗糙喷射性收缩期杂音。